煅白矾应注意
A. 温度不宜超过300℃
B. —次性煅透，中途不得停火
C. 两锅接合处应用盐泥堵封
D. 不得搅拌
E. 不宜用铁锅煅制

正确答案：B、D。—次性煅透，中途不得停火；不得搅拌

解析：本题考查的是白矾的炮制方法。煅白矾应注意—次性煅透，中途不得停火（B对）与不得搅拌（D对）。白矾：【炮制方法】处方用名有白矾、明矾、枯矾。①白矾：取原药材，除去杂质，捣碎或研细。②枯矾：取净白矾，敲成小块，置煅锅内，用武火加热至熔化，继续煅至膨胀松泡呈白色蜂窝状固体，完全干燥，停火，放凉后取出，研成细粉。煅制白矾时应一次性煅透，中途不得停火，不要搅拌。否则搅拌后堵塞了水分挥发的通路，易形成凉后的“僵块”。两锅接合处应用盐泥堵封（C错）为扣锅煅的操作方法。扣锅煅的操作方法：将药物置于锅中，上盖一较小的锅，两锅结合处用盐泥封严，扣锅上压一重物，防止锅内气体膨胀而冲开扣锅。扣锅底部贴一白纸条或放几粒大米，用武火加热，煅至白纸或大米呈深黄色，药物全部炭化为度。亦有在两锅盐泥封闭处留一小孔，用筷子塞住，时时观察小孔处的烟雾，当烟雾由白变黄并转呈青烟，之后逐渐减少时，降低火力，煅至基本无烟时，离火，待完全冷却后，取出药物。